能润肠通便的药是
A. 肉苁蓉
B. 淫羊藿
C. 骨碎补
D. 补骨脂
E. 绞股蓝

正确答案：A。肉苁蓉

解析：本题考查的是肉苁蓉的功效。能润肠通便的药是肉苁蓉（A对）。肉苁蓉：【功效】补肾阳，益精血，润肠通便。淫羊藿（B错）：【功效】补肾阳，强筋骨，祛风湿。骨碎补（C错）：【功效】补肾，活血，止痛，续伤。补骨脂（D错）：【功效】补肾壮阳，固精缩尿，温脾止泻，纳气平喘。绞股蓝（E错）：【功效】健脾益气，祛痰止咳，清热解毒。